下列对社区卫生服务的描述中，正确的是
A. 社区卫生服务的对象是社区中的患病人群
B. 社区卫生服务的地点是社区医院
C. 社区卫生服务提供的时间，应适应居民的需求
D. 当居民的健康问题得到解决后，社区卫生服务即可停止
E. 社区卫生服务的内容是对居民进行健康教育

正确答案：C。社区卫生服务提供的时间，应适应居民的需求

解析：社区卫生服务是在政府领导、社区参与、上级卫生机构指导下，以基层卫生机构为主体（B错），全科医师为骨干，合理使用社区资源和适宜技术，以人的健康为中心、家庭为单位、社区为范围、需求为导向，以妇女、儿童、老年人、慢性病人、残疾人、贫困居民等（A错）为服务重点，以解决社区主要卫生问题、满足基本卫生服务需求为目的，融预防、医疗、保健、康复、健康教育、计划生育技术服务功能等为一体的（E错），有效、经济、方便、综合、连续的基层卫生服务（D错）。社区卫生服务提供的时间，应适应居民的需求为正确答案（C对）。